《中国药典》规定二氧化硫残留量不得过10mg/kg的饮片是
A. 天花粉
B. 天麻
C. 白及
D. 白芍
E. 山药片

正确答案：E。山药片

解析：本题考查中药材中二氧化硫残留量。（4）二氧化硫残留量有的中药材在加工或储藏中常使用硫黄熏蒸以达到杀菌防腐、漂白药材的目的。目前许多国家对药品或食品中残留的二氧化硫均作了严格的限量。《中国药典》用酸碱滴定法、气相色谱法、离子色谱法分别作为第一法、第二法、第三法测定经硫黄熏蒸处理过的药材或饮片中二氧化硫的残留量。规定二氧化硫残留量不得过400mg/kg的药材和饮片有毛山药、光山药、天冬、天花粉（A错）、天麻（B错）、牛膝、白及（C错）、白术、白芍（D错）、党参、粉葛等。山药片（E对）不得过10mg/kg。